初产妇，末次月经第1天为4月21日，于12月29日就诊。腹部检查：子宫底在剑突下2横指，枕右前位胎心140次/分，血压16/10.3kPa，尿蛋白（-），本病例现在是
A. 妊娠满35周，子宫底高度符合正常情况
B. 妊娠满36周，子宫底高度低于正常
C. 妊娠满36周，子宫底高度符合正常情况
D. 妊娠满36周，子宫底高度高于正常情况
E. 妊娠满37周，子宫底高度高于正常情况

正确答案：C。妊娠满36周，子宫底高度符合正常情况

解析：初产妇，从末次月经计算该孕妇的预产期为次年1月28日，刚好就是下个月，40-4=36，所以该孕妇怀孕为36周，腹部检查：子宫底在剑突下2横指（子宫底高符合36周末），因此本病例现在是妊娠满36周，子宫底高度符合正常情况（C对）。